翼下颌间隙的说法中，不正确的是
A. 该间隙的额切面呈一底朝上、尖向下的三角形
B. 位于咬肌与下颌支之间
C. 间隙内的蜂窝组织向上与颞下间隙及颞间隙通连
D. 向前通颊间隙
E. 向后与咽旁间隙连通

正确答案：B。位于咬肌与下颌支之间

解析：翼下颌间隙或称翼颌间隙，位于下颌支与翼内肌之间。前为颞肌及颊肌，借颊肌与口腔分隔，后为腮腺，上界翼外肌下缘，下以翼内肌附丽于下颌支处为界。该间隙的额切面呈一底朝上、尖向下的三角形。间隙内主要有舌神经、下牙槽神经及下牙槽动、静脉通过。间隙内的蜂窝组织向上与颞下间隙及颞间隙通连，向前通颊间隙，向下与舌下、下颌下间隙相通，向后与咽旁间隙连通，向外通咬肌间隙。翼颌间隙尚可经颅底神经血管束通入颅内。掌握“面侧深区及颌面部各间隙的境界”知识点。